临床表现以惊悸不宁，失眠多梦，烦躁不安，苔黄滑，脉弦数为主的是
A. 心阴虚证
B. 心火亢盛证
C. 痰火扰神证
D. 痰蒙心神证
E. 胆郁痰扰证

正确答案：E。胆郁痰扰证

解析：“胆郁痰扰证，临床表现为胆怯易惊，惊悸不宁，失眠多梦，烦躁不安，胸胁胀闷，善太息，头晕目眩，口苦，呕恶，吐痰涎，舌淡红或红，苔白腻或黄滑，脉弦缓或弦数，本证以胆怯、惊悸、烦躁、失眠、眩晕、呕恶为辨证的主要依据”，本题临床表现与之相符，结合辨证依据，痰热内扰心神，神不守舍，则惊悸不宁，失眠多梦，烦躁不安；苔黄滑，脉弦数为痰热内蕴之征，故其证候为胆郁痰扰证（E对）。“心阴虚证，临床表现为心烦，心悸，失眠，多梦，口燥咽干，形体消瘦，或见手足心热，潮热盗汗，两颧潮红，舌红少苔乏津，脉细数，以心烦、心悸、失眠与阴虚症状共见为主”，本题临床表现与之不符（A错）。“心火亢盛证，临床表现为发热，口渴，心烦，失眠，便秘，尿黄，面红，舌尖红绛，苔黄，脉数有力。甚或口舌生疮、溃烂疼痛；或见小便短赤、灼热涩痛；或见吐血、衄血；或见狂躁谵语、神识不清，以发热、心烦、吐衄、舌赤生疮、尿赤与实火症状共见为主”，本题临床表现与之不符(B错）。“痰火扰神证，临床表现为发热，口渴，胸闷，气粗，咯吐黄痰，喉间痰鸣，心烦，失眠，甚则神昏谵语，或狂躁妄动，打人毁物，不避亲疏，胡言乱语，哭笑无常，面赤，舌质红，苔黄腻，脉滑数，，以神志狂躁、神昏谵语与痰热症状共见为主”，本题临床表现与之不符（C错）。“痰蒙心神证，临床表现为神情痴呆，意识模糊，甚则昏不知人，或情志抑郁，表情淡漠，喃喃独语，举止失常。或突然昏仆，不省人事，口吐涎沫，喉有痰声。并见面色晦暗，胸闷，呕恶，舌苔白腻，脉滑等症。以神志抑郁、错乱、痴呆、昏迷与痰浊症状共见为主”，本题临床表现与之不符（D错）。